农业生产中主要职业危害不包括
A. 化肥中毒
B. 农药中毒
C. 窖内气体中毒
D. 谷物粉尘引起的肺部疾患
E. 矽尘引起的肺部疾患

正确答案：E。矽尘引起的肺部疾患

解析：农业生产中的化学性有害因素主要有农药、化肥和有害气体。化肥和农药均为农业生产中的常用品，农产品在窖内贮藏时可能放出有害气体，因此化肥中毒（A对）、农药中毒（B对）和窖内气体中毒（C对）均属于农业生产中的职业危害。农业生产中的物理性有害因素主要有严寒酷暑，噪声和振动及粉尘，农业生产中接触的粉尘主要有泥土、植物粉尘和霉变物的粉尘，长期接触可能损伤肺功能，因此谷物粉尘引起的肺部疾患（D对）也属于农业生产中的职业危害。矽尘引起的肺部疾患多见于长期接触各种金属、煤粉、耐火材料、石粉、水泥、玻璃、陶瓷等工种的工人，不是农业生产中的主要职业危害（E错，为本题正确答案）。